可采用风险评估法制定UL的物质是
A. 维生素B₂
B. 维生素B₁₂
C. 肉碱
D. 叶黄素
E. 叶酸

正确答案：E。叶酸

解析：本题考查可采用风险评估法制定UL的物质。采用风险评估法制定UL值的前提是该物质具有已知的不良作用、能得出LOAEL/NOAEL或其他毒性参考值，如叶酸（E对CD错）。有些营养索即使在最高的实际应用剂量下，都未观察到不良健康效应，如维生素B₂（A错）、维生素B₁₂（B错）等。